治疗皮肤鳞状上皮癌的药物是
A. 争光霉素
B. 马利兰
C. 放线菌素D（更生霉素）
D. 环磷酰胺
E. 雌激素

正确答案：A。争光霉素

解析：本题考查争光霉素。治疗皮肤鳞状上皮癌的药物是争光霉素（A对）。争光霉素又称博来霉素，用于治疗睾丸癌、恶性淋巴瘤和鳞状上皮细胞癌，也可用于皮肤恶性肿瘤、头颈部肿瘤、肺癌、食管癌、恶性淋巴瘤、子宫颈癌等。马利兰（B错）又称为白消安，治疗慢性粒细胞白血病效果显著。放线菌素D（更生霉素）（C错）对霍金奇病、绒毛膜癌和肾母细胞瘤有较好的疗效。环磷酰胺（D错）对恶性淋巴瘤疗效显著，对多发性骨髓瘤、急性淋巴细胞白血病、卵巢癌、乳腺癌等也有效。雌激素（E错）用于前列腺癌、晚期乳腺癌有内脏或组织转移绝经后7年以上的妇女。